腹部平片不易显影的尿结石是
A. 磷酸盐结石
B. 草酸盐结石
C. 碳酸盐结石
D. 尿酸结石
E. 混合结石

正确答案：D。尿酸结石

解析：尿结石（七版黄家驷外科学P2339）主要由尿中难溶的无机盐、有机盐和酸的晶体所组成，临床上常以晶体成分命名结石。尿结石中，以含钙结石最常见，在X线平片上能显影，称为阳性结石，如草酸钙结石（B错）、磷酸钙结石（A错）、碳酸钙结石（C错）、混合性结石（E错）等。尿酸结石（D对）与尿酸代谢异常有关，不含钙盐成分，其结石可透过X线，在X线平片上不显影，称为阴性结石。